30岁女性，3年前产一死婴，近2年来烦渴多饮，日饮水量波动在1.5～2L，夜间饮水量明显少于白天，月经正常，无消瘦或乳房萎缩，入院后对主动限水耐受性好，禁水试验尿比重大于1.018，CT未见垂体或鞍区异常，最可能的诊断是
A. 席汗病
B. 颅咽管瘤
C. 完全性尿崩
D. 部分性尿崩
E. 精神性饮水

正确答案：E。精神性饮水

解析：青年女性，3年前产一死婴（该患者有精神影响因素），夜间饮水量明显少于白天，月经正常，无消瘦等症状，入院后禁水试验尿比重大于1.018（正常值为1.010～1.025，说明患者精氨酸升压素释放正常），CT未见垂体或鞍区异常（不考虑器质性病变），最可能的诊断是精神方面因素导致的饮水（E对）。席汗病（P354）（A错）又称希恩综合征，由于产后大出血休克，导致垂体尤其是腺垂体促性腺激素分泌细胞缺血坏死，引起腺垂体功能低下而出现一系列症状。颅咽管瘤（P354）（B错）CT扫描可发现肿瘤钙化和囊性变，该患者CT未见垂体或鞍区异常。根据AVP（精氨酸升压素）缺乏的程度，可分为完全性尿崩症（C错）和部分性尿崩症（D错），尿崩症的主要临床表现为多尿、烦渴与多饮，起病常较急，一般起病日期明确，24小时尿量可多达5～10L，一般不超过18L，尿比重常在1.005以下，尿渗透压常为50～200mOsm/kg，尿色淡如清水。